牙折常发生于下述牙位
A. 上前牙
B. 下前牙
C. 单尖牙
D. 前磨牙
E. 磨牙

正确答案：A。上前牙

解析：本题考查牙折的好发牙位。牙折是指牙齿受到急剧的机械外力作用造成的牙齿折断，多由外力直接撞击造成，也可因咀嚼时咬到砂石、碎骨等硬物而发生。上前牙在颜面部位置最为突出，最易受到外力撞击的影响，牙折常发生于上前牙（A对）。下前牙（B错）、单尖牙（C错）、前磨牙（D错）、磨牙（E错）以可因外力或咀嚼硬物而发生牙折，其中牙折多发生于承担较大咀嚼负荷的磨牙，但牙折发生率远小于上前牙。